外感咳嗽的病位主要在
A. 脾
B. 心
C. 肺
D. 肾
E. 肝

正确答案：C。肺

解析：外感咳嗽为六淫外邪在肺卫功能失调或减弱的情况下，遇气候突变或冷热失常时，乘虚从口鼻而入，或从皮毛侵袭，伤及肺系，是肺失宣降，气机上逆引起咳嗽，故外感咳嗽的病位在肺（C对）。咳嗽还与肝脾有关，久则及肾（ABDE错）。